我国制定的《人胚胎干细胞研究指导原则》规定中，允许
A. 研究性克隆
B. 通过体细胞核移植获得的囊胚培养已15天用于人胚干细胞研究
C. 将人胚植入动物的生殖系统
D. 将体细胞核移植获得的囊胚植入人的子宫
E. 买卖人类配子、受精卵、胚胎

正确答案：A。研究性克隆

解析：本题考查《人胚胎干细胞研究指导原则》。我国制定的，《人胚胎干细胞研究指导原则》规定中，允许研究性克隆（A对）；禁止进行生殖性克隆人的任何研究。进行人胚胎干细胞研究，必须遵守以下行为规范：利用体外受精、体细胞核移植技术、单性复制技术或遗传修饰获得的囊胚，其体外培养期限自受精或核移植开始不得超过14天（B错）；不得将前款中获得的已用于研究的人囊胚植入人（D错）或任何其他动物的生殖系统（C错）；不得将人的生殖细胞与其他物种的生殖细胞结合；禁止买卖人类配子、受精卵、胚胎和胎儿组织（E错）。